对简单扩散的特点描述正确的是
A. 物质分子由浓度低的部位向浓度高的部位分散
B. 消耗能量
C. 依赖于外源性化学物质在脂质中的溶解度
D. 不受外源性化学物质的电离状态影响
E. 以上都对

正确答案：C。依赖于外源性化学物质在脂质中的溶解度